含有3-OH的是
A. 橙酮
B. 异黄酮
C. 黄酮醇
D. 二氢黄酮
E. 黄烷

正确答案：C。黄酮醇

解析：本题考查的是黄酮类化合物的主要结构类型。含有3-OH的是黄酮醇（C对）。黄酮醇类（C对）的羟基在3-位上。橙酮（A错）类、异黄酮（B错）类、二氢黄酮（D错）类、黄烷（E错）类均不含3-OH。